防止食物落入气管的结构是
A. 喉口
B. 舌根
C. 会厌
D. 前庭裂
E. 声门裂

正确答案：C。会厌

解析：会厌（C对）是防止食物落入气管的结构。